关于注射剂特点的说法，错误的是
A. 起效迅速、剂量准确、作用可靠
B. 适用于不宜口服的药物
C. 可发挥局部定位治疗作用
D. 不易发生交叉污染
E. 制造过程复杂，生产成本较高

正确答案：D。不易发生交叉污染

解析：本题考查注射剂特点。注射剂的特点有：（1）药效迅速、剂量准确、作用可靠（A对）。（2）可适用于不宜口服给药的患者和不宜口服的药物（B对）。（3）可发挥局部定位作用（C对），但注射给药不方便，注射时易引起疼痛。（4）易发生交叉污染（D错，为本题正确答案），安全性不及口服制剂。（5）制造过程复杂，对生产的环境及设备要求高，生产费用较大，价格较高（E对）。